下述哪个论点是不正确的
A. 甲肝没有慢性携带者
B. 乙肝潜伏期即有传染性
C. 无症状携带者是丁肝的主要传染源
D. 慢性患者是丙肝的重要传染源
E. 慢性携带者是戊肝重要传染源

正确答案：E。慢性携带者是戊肝重要传染源

解析：本题考查病毒性肝炎的传染源特点。甲肝没有慢性携带者（A对）；乙肝在潜伏期有传染性（B对）；无症状携带者是丁肝的主要传染源（C对）；慢性患者是丙肝的重要传染源（D对）；戊肝的传染源主要是戊肝病人和感染的动物，并非慢性携带者（E错，为本题正确答案）。